满山红的质量控制成分
A. 芦丁
B. 杜鹃素
C. 麻黄碱
D. 大黄素甲醚
E. 人参皂苷Rg₁

正确答案：B。杜鹃素

解析：本题考查的是满山红的质量控制成分。满山红的质量控制成分杜鹃素（B对）。满山红叶中含有杜鹃素、8-去甲基杜鹃素、山柰酚、槲皮素、杨梅素、金丝桃苷、异金丝桃苷以及莨菪亭、伞形酮、木毒素、牻牛儿酮、薄荷醇、杜松脑和α-桉叶醇、β-桉叶醇、γ-桉叶醇等。其中杜鹃素为祛痰成分，临床用于治疗慢性支气管炎。《中国药典》以杜鹃素为对照品对满山红进行含量测定。要求杜鹃素含量不少于0.08%。芦丁（A错）为槐米的质量控制成分。槐米含有芦丁，槲皮素，皂苷等。其中，芦丁是有效成分。槐米中芦丁的含量高达23.5%，槐花开放后降至13.0%。《中国药典》以总黄酮和芦丁为指标成分对槐米或槐花进行含量测定。要求槐花总黄酮（以芦丁计）不少于8.0%，槐米总黄酮不少于20.0%，对照品采用芦丁；要求芦丁含量，槐花不得少于6.0%，槐米不得少于15.0%。麻黄碱（C错）为麻黄的质量控制成分。麻黄中含有多种生物碱，以麻黄碱和伪麻黄碱为主，前者占总生物碱的40%～90%，《中国药典》以盐酸麻黄碱和盐酸伪麻黄碱为指标成分进行含量测定，要求药材和饮片含盐酸麻黄碱和盐酸伪麻黄碱的总量不得少于0.80%。此外麻黄还含少量的甲基麻黄碱、甲基伪麻黄碱和去甲基麻黄碱、去甲基伪麻黄碱。大黄素甲醚（D错）为大黄的质量控制成分。从大黄中分离得到蒽醌、二蒽酮、芪、苯丁酮、单宁、萘色酮等不同种类的80多种化合物，大体上可分为蒽醌类、多糖类与鞣质类。其中蒽醌类及其衍生物含量为3%～5%，分为游离型与结合型。《中国药典》以总蒽醌和游离蒽醌为指标成分，采用高效液相色谱法测定药材和饮片中芦荟大黄素、大黄酸、大黄素、大黄酚和大黄素甲醚等总蒽醌的含量，要求药材总蒽醌不得少于1.5%，游离蒽醌不得少于0.20%。人参皂苷Rg₁（E错）为人参的质量控制成分。人参含有皂苷、多糖和挥发油等多种化学成分，人参皂苷为人参的主要有效成分之一。《中国药典》以人参皂苷为指标成分对人参、红参和人参叶进行含量测定。其中，人参和红参的质量控制成分为人参皂苷Rg₁、人参皂苷Re和人参皂苷Rb₁。